需密闭，2～10℃冷处保存的药品
A. 双氯芬酸片
B. 硝普钠片
C. 降钙素鼻喷雾剂
D. 阿司匹林
E. 头孢呋辛酯片

正确答案：C。降钙素鼻喷雾剂

解析：本题考查药品的贮存。降钙素（密钙息）鼻喷雾剂（C对）需要在冷处即2～10℃贮存。硝普钠（B错）易受光线影响而变质，因此需密闭、遮光，在阴凉干燥处保存。头孢呋辛酯（E错）应遮光，密封，在阴凉（不超过20℃）处保存。双氯芬酸片（A错）应密闭，在干燥处保存。阿司匹林片（D错）须注意干燥保存。